除另有规定外，应检查金属性异物的眼用制剂是
A. 眼膜剂
B. 洗眼剂
C. 滴眼剂
D. 眼膏剂
E. 眼内注射溶液

正确答案：D。眼膏剂

解析：本题考查的是眼用制剂的分类、质量检查项目与要求。除另有规定外，应检查金属性异物的眼用制剂是眼膏剂（D对）。眼用制剂可分为眼用液体制剂（滴眼剂（C错）、洗眼剂（B错）、眼内注射溶液（E错）等）、眼用半固体制剂（眼膏剂、眼用乳膏剂、眼用凝胶剂等）、眼用固体制剂（眼膜剂（A错）、眼丸剂、眼内插入剂等）。眼用液体制剂也可以固态形式包装，另备溶剂，在临用前配置成溶液或混悬液。眼用制剂质量检查项目与要求：除另有规定外，眼用制剂的无菌、装量、渗透压摩尔浓度以及滴眼剂、眼内注射溶液的可见异物、含饮片原粉的眼用制剂和混悬型眼用制剂的粒度、眼用半固体制剂的金属性异物、混悬型滴眼剂（含饮片细粉的滴眼剂除外）的沉降体积比等检查应符合《中国药典》制剂通则眼用制剂项下的有关规定。凡规定检查含量均匀度的眼用制剂，一般不再进行装量差异检查。